在病例对照研究中，最佳对照人群是
A. 医院内的其他疾病患者人群
B. 与病例来自同一源人群
C. 病例的亲属人群
D. 病例的邻居或同事人群
E. 某一社区人群

正确答案：B。与病例来自同一源人群

解析：本题考查病例对照研究中对照人群的选择。在病例对照研究中，最佳的对照人群是与病例来自同一源人群（B对ACDE错）。